根据《药品经营许可证管理办法》，由原发证机关注销《药品经营许可证》的情形不包括
A. 《药品经营许可证》有效期届满未换证的
B. 药品经营企业负责人在药品购销活动中，收受其他经营企业的财物，构成犯罪的
C. 《药品经营许可证》被依法撤销、撤回、吊销、收回和缴销的
D. 不可抗力导致《药品经营许可证》的许可事项无法实施的
E. 药品经营企业终止经营药品或关闭的

正确答案：B。药品经营企业负责人在药品购销活动中，收受其他经营企业的财物，构成犯罪的

解析：本题考查的是药品生产许可证管理。根据《药品经营许可证管理办法》，由原发证机关注销《药品经营许可证》的情形不包括药品经营企业负责人在药品购销活动中，收受其他经营企业的财物，构成犯罪的（B错，为本题正确答案）。注销药品生产许可证的情形：有下列情形之一的，药品生产许可证由原发证机关注销，并予以公告：①主动申请注销药品生产许可证的；②药品生产许可证有效期届满未重新发证的（A对）；③营业执照依法被吊销或者注销的（C对）；④药品生产许可证依法被吊销或者撤销的；⑤法律、法规规定应当注销行政许可的其他情形（DE对）。